下列哪项指标表示水体受到粪便污染
A. 余氯量
B. 氯化物含量
C. 总大肠菌群
D. 钙、镁总量
E. 氟化物

正确答案：C。总大肠菌群

解析：本题考查表示水体受到粪便污染的指标。总大肠菌群是指一群在37℃培养24～48小时能发酵乳糖并产酸产气的革兰氏阴性无芽孢杆菌。总大肠菌群（C对ABDE错）是水体受到粪便污染的最常用指标，它可以反映水体中的粪便污染程度。